诱导IgE产生的主要细胞因子是
A. IL-1
B. IL-2
C. IL-4
D. IL-3
E. IL-6

正确答案：C。IL-4